下述结构中靠近食管胸部右侧的是
A. 上腔静脉
B. 奇静脉弓
C. 主动脉弓
D. 胸导管
E. 左心房

正确答案：B。奇静脉弓

解析：食管胸部位于上纵隔后部和后纵隔，其毗邻结构有：（1）前方：气管、气管杈、左主支气管、左喉返神经、心包、左心房（E错）；（2）后方：胸主动脉、胸导管（D错）、奇静脉、半奇静脉；（3）左侧：左颈总动脉、主动脉弓（C错）、胸主动脉、胸导管上段；（4）右侧：奇静脉弓（B对）。上腔静脉（A错）在右侧第2胸肋关节下缘注入右心房，主要位于食管胸部上后方。